根据《化学药品和治疗用生物制品说明书规范细则》，说明书【药品名称】项中内容及排列顺序的要求是
A. 只需要列明通用名称和英文名称
B. 只需要注明通用名称和汉语拼音
C. 必须注明商品名称，但无需加注汉语拼音
D. 应按通用名称、拉丁名称、商品名称、汉语拼音顺序列明
E. 应按通用名称、商品名称、英文名称、汉语拼音顺序列明

正确答案：E。应按通用名称、商品名称、英文名称、汉语拼音顺序列明

解析：本题考查药品说明书的格式和书写要求。根据《化学药品和治疗用生物制品说明书规范细则》，说明书【药品名称】项中内容及排列顺序的要求是应按通用名称、商品名称、英文名称、汉语拼音顺序列明（E对）。【药品名称】按下列顺序列出：（1）通用名称：中国药典收载的品种，其通用名称应当与药典一致；或者与国家批准的该品种药品标准中的药品名称一致；药典未收载的品种，其名称应当符合药品通用名称命名原则。（2）商品名称：未批准使用商品名称的药品不列该项。（3）英文名称：无英文名称的药品不列该项。（4）汉语拼音：。